肝硬化自发性细菌性腹膜炎的常见感染途径
A. 直接扩散
B. 上行性感染
C. 透壁性感染
D. 血行播散
E. 淋巴感染

正确答案：C。透壁性感染

解析：一般情况下，原发性腹膜炎多为血行感染（D错），病原菌多为溶血性链球菌，少数为大肠埃希菌（大肠杆菌）、克雷伯杆菌和淋球菌，肝硬化时，因患者肠道细菌过度生长和肠壁通透性增加，肠壁局部免疫防御功能下降，使肠腔内细菌发生易位经过肠系膜淋巴结进入循环系统产生菌血症，发生肝硬化自发性细菌性腹膜炎，故此时的常见感染途径为透壁性感染（C对）。